环磷酰胺对何种肿瘤疗效最显著
A. 卵巢癌
B. 急性淋巴细胞性白血病
C. 肺癌
D. 多发性骨髓瘤
E. 恶性淋巴瘤

正确答案：E。恶性淋巴瘤

解析：环磷酰胺的临床应用：抗瘤谱广，为目前广泛应用的烷化剂。对恶性淋巴瘤疗效显著，对多发性骨髓瘤、急性淋巴细胞白血病、肺癌、乳腺癌、卵巢癌、神经母细胞瘤和睾丸肿瘤等均有一定疗效。掌握“抗恶性肿瘤药”知识点。